女，45岁。车祸致头部外伤伴昏迷1小时入院。查体：P55次/分，R12次/分，BP170/100mmHg，右侧顶枕部头皮血肿，GCS评分7分。左侧曈孔直径4mm，对光反射消失，右侧曈孔直径2mm，右侧肢体偏瘫。头颅CT示左颞叶脑内高密度影，体积约60ml。左额，颞底而广泛斑点状高密度影致同侧脑室受压，中线向右移位1.5cm。最可能的诊断是
A. 外伤性脑积水
B. 急性硬脑膜外血肿
C. 急性硬脑膜下血肿
D. 脑挫裂伤伴脑内血肿
E. 脑震荡

正确答案：D。脑挫裂伤伴脑内血肿

解析：该患者CT示左额，颞底广泛斑点状高密度影，提示脑挫裂伤；左颞叶脑内高密度影，体积约60ml，提示脑内血肿（D对）。外伤性脑积水（A错）CT扫描常表现为脑室系统扩大，尤以侧脑室前角为著；侧脑室周围有明显的间质性水肿带。急性硬脑膜外血肿（B错）的主要症状为进行性意识障碍，CT扫描示颅骨内板与硬脑膜之间的双凸镜形或弓形高密度影。急性硬脑膜下血肿（C错）多表现为伤后持续昏迷或昏迷进行性加重，CT扫描显示脑表面新月形高密度、混杂密度或等密度影。脑震荡（E错）多表现为伤后立即出现短暂的意识丧失，持续数分钟至十余分钟，一般不超过半小时，CT检查颅内无异常。